女，72岁。不慎摔伤右髋部。查体：右下肢短缩，外旋50°畸形，右髋肿胀不明显，但有叩痛。为证实诊断首先需要的检查是
A. X线片
B. CT
C. MRI
D. 核素骨扫描
E. 关节造影

正确答案：A。X线片